急性心肌梗死最晚恢复正常的心肌坏死标志物是
A. 肌红蛋白
B. 肌酸激酶
C. 肌酸肌酶同工酶MB
D. 天门冬酸氨基转移酶
E. 肌钙蛋白

正确答案：E。肌钙蛋白

解析：临床常用的肌钙蛋白（E对）分为两种，肌钙蛋白I在7～10日恢复正常，肌钙蛋白T在10～14日恢复正常。肌红蛋白（A错）在24～48小时内恢复正常。肌酸激酶（B错）在3～4天恢复正常（九版诊断学P388）。肌酸激酶同工酶MB（C错）在3～4天恢复正常。天门冬酸氨基转移酶（D错）3～6天恢复正常。综上所诉，急性心肌梗死最晚恢复正常的心肌坏死标志物是肌钙蛋白。